下列关于气雾剂的说法，正确的有
A. 由药物、附加剂、抛射剂、耐压容器、阀门组成
B. 抛射剂提供动力，还可作为溶剂，稀释剂
C. 乳浊液型混悬液型气雾剂为三相气雾剂
D. 肺泡为主要吸收部位
E. 吸入药物吸收速度与脂溶性、分子大小成反比

正确答案：A、B、C、D。由药物、附加剂、抛射剂、耐压容器、阀门组成；抛射剂提供动力，还可作为溶剂，稀释剂；乳浊液型混悬液型气雾剂为三相气雾剂；肺泡为主要吸收部位

解析：本题考查的是气雾剂。下列关于气雾剂的说法，正确的有由药物、附加剂、抛射剂、耐压容器、阀门组成（A对）、抛射剂提供动力，还可作为溶剂，稀释剂（B对）、乳浊液型混悬液型气雾剂为三相气雾剂（C对）与肺泡为主要吸收部位（D对）。气雾剂系指原料药物或原料药物和附加剂与适宜的抛射剂共同装封于具有特制阀门系统的耐压容器中，使用时借助抛射剂的压力将内容物呈雾状物喷出，用于肺部吸入或直接喷至腔道黏膜、皮肤的制剂。气雾剂内容物喷出后呈泡沫状或半固体状，则称之为泡沫剂或凝胶剂/乳膏剂。气雾剂的分类：①按用药途径，气雾剂可分为吸入气雾剂、非吸入气雾剂。②按处方组成，气雾剂可分为二相气雾剂（气相和液相）和三相气雾剂（气相、液相、固相或液相）。溶液型气雾剂属于二相气雾剂，乳浊液和混悬液型气雾剂属于三相气雾剂。③按给药定量与否，气雾剂可分为定量气雾剂和非定量气雾剂。吸入气雾剂和吸入喷雾剂的吸收与影响因素：吸入气雾剂和吸入喷雾剂给药时，药物以雾状吸入可直接作用于支气管平滑肌，适宜粒径的雾滴在肺泡部位有较好的分布和沉积，肺泡为药物的主要吸收部位。影响吸入气雾剂和吸入喷雾剂药物吸收的主要因素有：①药物的脂溶性及分子大小，吸入给药的吸收速度与药物的脂溶性成正比，与药物的分子大小成反比（E错）。②雾滴（粒）粒径大小，雾滴（粒）的大小影响其在呼吸道沉积的部位，吸入气雾剂雾滴（粒）的粒径应在10μm以下，其中大多数应在5μm以下。雾滴过粗，药物易沉着在口腔、咽部及呼吸器官的各部位；粒子过小，雾滴（粒）易到达肺泡部位，但沉积减少，多被呼出，吸收较少。气雾剂的构成：气雾剂由药物与附加剂、抛射剂、耐压容器和阀门系统构成。气雾剂的抛射剂：为适宜的低沸点液化气体。抛射剂是喷射药物的动力，有时兼作药物的溶剂和稀释剂。